属于实验性研究的是
A. 疾病监测
B. 队列研究
C. 临床试验
D. 临床指南
E. 系统评价

正确答案：C。临床试验

解析：本题考查实验性研究的类型。实验性研究按其研究目的和研究对象的不同，通常分为临床试验（C对ABDE错）、现场试验和社区试验三类。